下列属于《传染病防治法》规定的乙类传染病的是
A. 鼠疫
B. 流行性感冒
C. 人感染高致病性禽流感
D. 黑热病
E. 霍乱

正确答案：C。人感染高致病性禽流感

解析：乙类传染病是指：传染性非典型肺炎、艾滋病、病毒性肝炎、脊髓灰质炎、人感染高致病性禽流感（C对）、麻疹、流行性出血热、狂犬病、流行性乙型脑炎、登革热、炭疽、细菌性和阿米巴性痢疾、肺结核、伤寒和副伤寒、流行性脑脊髓膜炎、百日咳、白喉、新生儿破伤风、猩红热、布鲁氏菌病、淋病、梅毒、钩端螺旋体病、血吸虫病、疟疾。甲类传染病是指：鼠疫（A错）、霍乱（E错）（P59）。丙类传染病是指：流行性感冒（B错）、流行性腮腺炎、风疹、急性出血性结膜炎、麻风病、流行性和地方性斑疼伤寒、黑热病（D错）、包虫病、丝虫病，除霍乱、细菌性和阿米巴性痢疾、伤寒和副伤寒以外的感染性腹泻病（P60）。